下列支持ITP诊断的是
A. 肝脾肿大
B. 骨髓中产板型巨核细胞增多
C. PAIg阴性
D. PAC3阴性
E. 脾切除治疗有效

正确答案：E。脾切除治疗有效

解析：ITP是由于患者对自身血小板抗原的免疫失耐受，产生体液免疫和细胞免疫介导的血小板破坏过多和血小板生成受抑，导致血小板减少，患者血浆和血小板表面可检测到PAIg（血小板相关抗体）阳性（C错）、PAC3（血小板相关补体）阳性（D错），骨髓中巨核细胞正常或增多，幼稚型巨核细胞增多，产板型巨核细胞减少（B错），患者肝脾一般不大（A错），ITP为免疫性疾病，脾切除治疗有效（E对）。